某幼儿园膳食调查结果显示，4岁儿童每人每天维生素C平均摄入量为80mg，已超过DRIs，但维生素C尿负荷试验结果显示：80％的幼儿有维生素C摄入不足的情况，其可能原因中不包括
A. 蔬菜搁置太久
B. 清洗不合理，先切后洗
C. 蔬菜在水中浸泡时间太长
D. 未做到急火快炒
E. 蔬菜供应太少

正确答案：E。蔬菜供应太少